含有羟基内酯结构和氢化萘环骨架的HMG-CoA还原酶抑制剂的调血脂药物是
A. 瑞舒伐他汀钙
B. 洛伐他汀
C. 吉非罗齐
D. 非诺贝特
E. 氟伐他汀钠

正确答案：B。洛伐他汀

解析：本题考查他汀类药物。洛伐它丁（B对）是含有羟基内酯结构和氢化萘环骨架的HMG-CoA还原酶抑制剂类调血脂药物；瑞舒伐他汀钙（A错）含嘧啶环；吉非罗齐（C错）为苯氧戊酸衍生物；非诺贝特（D错）是苯氧乙酸类药物；氟伐他汀钠（E错）是含吲哚环。